防止院内感染的关键是
A. 严格执行入院制度和探视制度
B. 隔离病人
C. 提高全院医护人员预防知识和隔离消毒技术
D. 搞好医院内外环境卫生
E. 设立专门的组织机构，负责院内感染的调查，管理和预防

正确答案：E。设立专门的组织机构，负责院内感染的调查，管理和预防

解析：本题考查防止院内感染的关键。防止院内感染的关键在于设立专门的组织机构，负责院内感染的调查，管理和预防（E对ABCD错）。